肝硬化患者，血氨增高的常见诱因是（选项存疑，如有问题，请在评论区补充）
A. 肠道内细菌活动减弱
B. 胃肠活动增强
C. 高蛋白饮食
D. 糖摄入增多
E. 脂肪摄入增多

正确答案：C。高蛋白饮食

解析：消化道是氨产生的主要部位，肝性脑病常因胃肠道出血、感染、过量摄入蛋白质（C对）、镇静药、利尿剂而诱发。